上述各项，属霍乱严重并发症的是
A. 急性肾衰竭
B. 感染中毒性休克
C. 肠出血
D. 肠穿孔
E. ARDS

正确答案：A。急性肾衰竭

解析：急性肾衰竭 表现为少尿、无尿，尿比重低。发病初期由于剧烈的吐泻导致脱水，出现肾前性少尿，及时补液可不发生肾衰竭。若得不到及时纠正。可由于督小管缺血性坏死。出现少尿、无尿、氮质血症，严重者出现尿毒症而死亡。为最常见的严重并发症（A对）。